一名3个月婴儿，体重6kg，每日需喂8%糖牛奶量和需水量分别为
A. 300ml、600ml
B. 400ml、700ml
C. 500ml、800ml
D. 600ml、900ml
E. 700ml、900ml

正确答案：D。600ml、900ml

解析：一名3个月婴儿，体重6kg，每日需喂8%糖牛奶量为600ml（600ml全牛奶，48g蔗糖），每日需水900ml，故除全牛奶外尚需分次供水共约300ml。全日奶量可分为5次喂哺，全牛奶与水可同时或间隔喂给。掌握“婴儿喂养方法”知识点。